凡生疮疡，毒不外泄，反陷入里，称为
A. 走黄
B. 内陷
C. 流注
D. 毒邪内攻
E. 流火

正确答案：B。内陷

解析：因正气虚弱，火毒炽盛，正不胜邪，反陷于内，内攻脏腑而成内陷（B对）。由于疔疮毒邪炽盛，疔毒走散，毒入血分，内攻脏腑而成走黄，又称“疔疮走黄”（A错）；流注（C错）是发于肌肉深部的急性化脓性疾病，总因正气不足，邪毒流窜，使经络阻隔、气血凝滞而成。下肢丹毒称为“流火”，总因血热火毒为患（E错）。毒邪内陷为走黄与内陷的病机，包括疔毒与其他疮疡肿毒内攻（D错）。